治疗洋地黄中毒，下列哪一项是错误的
A. 停用洋地黄制剂
B. 停用排钾利尿剂
C. 凡是心律失常均给予苯妥英钠治疗
D. 利多卡因可用于室性快速心律失常的治疗
E. 阿托品可用于缓慢心律失常的治疗

正确答案：C。凡是心律失常均给予苯妥英钠治疗

解析：洋地黄中毒时应立即停药（A对）；血钾过低时容易发生各种快速性心律失常，应停用排钾利尿剂（B对）；单发性室性期前收缩、一度房室传导阻滞等停药后常自行消失（C错，为本题正确答案）。对快速性心律失常者，如血钾浓度低可用静脉补钾，如血钾不低可用利多卡因和苯妥英钠，利多卡因可用于室性快速心律失常的治疗（D对）；有传导阻滞及缓慢性心律失常者可予阿托品静脉注射（E对）。